根据主观感觉结合环境因素测定而制定的小气候综合评价指标是
A. 黑球温度
B. 湿球-黑球温度
C. 有效温度
D. 热强度指数
E. 热平衡指数

正确答案：C。有效温度

解析：本题考查小气候综合评价指标。小气候的综合评价指标可分为四类：第一类是根据环境因素的测定而制订的评价指标，如：湿球温度，黑球温度（A错）等。第二类是根据主观感觉结合环境因素测定而制订的评价指标，如：有效温度（C对）、校正有效温度、风冷指数等。第三类是根据生理反应结合环境因素测定而制订的评价指标，如：湿球-黑球温度指数（B错）等。第四类是根据机体与环境之间热交换情况而制订的评价指标，如：热强度指数（D错）、热平衡指数（E错）等。